恒牙胚的形成位于乳牙胚的
A. 唇侧
B. 近中侧
C. 舌侧
D. 远中侧
E. 下方

正确答案：C。舌侧

解析：乳牙胚形成后，在其舌侧，从牙板的游离缘下端形成新的恒牙胚，并且发育过程和乳牙胚相同。掌握“牙胚的发生及分化”知识点。